如何鉴别中枢性尿崩和肾性尿崩
A. 查血浆浓度和尿渗透压
B. 查尿渗透压和尿钠
C. 禁饮水实验
D. 加压素实验
E. 测定尿渗透压和比重

正确答案：D。加压素实验

解析：加压素实验可以鉴别中枢性尿崩和肾性尿崩，在注射加压素后，尿渗透压进一步升高，较注射前至少增加9% 以上为中枢性尿崩症。在禁水后尿液不能浓缩，注射加压素后仍无反应是肾性尿崩症（D对ABCE错）。